女，58岁。乏力、低热1个月。查体：双侧颈部、腋窝和腹股沟均可触及肿大淋巴结，最大者直径2cm、质韧、无触痛，胸骨无压痛，肝肋下未触及，脾肋下3cm。实验室检查：Hb76g/L，WBC5.2×10⁹/L，Plt123×10⁹/L，网织红细胞0.14，coombs试验（+），尿胆红素（—），尿胆原（+++）。最可能得诊断是
A. 急性粒细胞白血病
B. 淋巴瘤
C. 淋巴结炎
D. 急性淋巴细胞白血病
E. 骨髓增生异常综合征

正确答案：B。淋巴瘤

解析：患者中老年女性，乏力低热1个月（乏力、低热为淋巴瘤常见的全身症状），查体：双侧颈部、腋窝和腹股沟均可触及肿大淋巴结，无触痛，脾脏肿大（无痛性淋巴结肿大为淋巴瘤共同的临床表现，淋巴结、扁桃体、脾及骨髓是淋巴瘤最易受累的部位）提示淋巴瘤，实验室检查：WBC5.2×10⁹／L（正常4～10×10⁹／L）正常，Plt123×10⁹／L（正常100～300×10⁹／L）正常，Hb76g／L（成年女性Hb正常值110～150g/L），网织红细胞0.14（正常0.005～0.015）增高，Coombs试验（+），尿胆红素（-），尿胆原（+++）提示抗人球蛋白试验阳性的溶血性贫血（可见于B细胞非霍奇金淋巴瘤），故患者最可能的诊断为淋巴瘤（B对），且非霍奇金淋巴瘤可能性大。急性粒细胞白血病（P571）（A错）、急性淋巴细胞白血病（P571）（D错）常表现为感染、出血、贫血，可有肝脾淋巴结肿大，胸骨压痛，外周血白细胞常增高，红细胞、血小板多减少；淋巴结炎（C错）常局限，有红、肿、热、痛等表现；骨髓增生异常综合征（P564）（E错）表现为骨髓病态造血，外周血三系减少，无全身无痛性淋巴结肿大。